某企业拟在H省开办药品零售企业。具有药品零售企业开办审批职权的药品监督管理部门包括
A. H省省管P县负责药品监督管理的部门
B. H省Z设区的市负责药品监督管理的部门
C. H省S设区的市A县负责药品监督管理的部门
D. H省省会L市B区负责药品监督管理的部门

正确答案：A、B。H省省管P县负责药品监督管理的部门；H省Z设区的市负责药品监督管理的部门

解析：本题考查的是药品零售企业的许可。某企业拟在H省开办药品零售企业。具有药品零售企业开办审批职权的药品监督管理部门包括H省省管P县负责药品监督管理的部门或H省Z设区的市负责药品监督管理的部门（AB对）。药品零售企业的许可：开办药品零售企业（含药品零售连锁企业门店）的，应当向县级以上药品监督管理部门（CD错）申请，经审批同意，依法获取《药品经营许可证》后，方可开展相应药品经营活动。